可作眼膏剂基质的是
A. 黄凡士林
B. 甘油
C. 羟苯乙酯
D. 月桂醇硫酸钠
E. 乙醇

正确答案：A。黄凡士林

解析：本题考查眼膏剂的基质。眼膏剂常用的基质一般用黄凡士林（A对）8份，液体石蜡、羊毛脂各1份混合而成。